赭石味苦，其作用特点是
A. 通泄
B. 坚阴
C. 降泄
D. 散泄
E. 坚厚肠胃

正确答案：C。降泄

解析：本题考查的是五味对人体的效果。赭石味苦，其作用特点是降泄（C对）。苦：能泄、能燥、能坚。其中，能泄的含义有三：一指苦能通泄（A错），如大黄苦寒，功能泻热通便，治热结便秘每用。二指苦能降泄，如苦杏仁味苦降泄肺气，治咳喘气逆必投；代赭石味苦而善降逆，治呃逆呕喘常选。三指苦能清泄，如黄连、栀子味苦，能清热泻火，治火热内蕴或上攻诸证宜择。能燥即指苦能燥湿，如治寒湿的苍术、厚朴，治湿热的黄柏、苦参等，均为苦味。能坚的含义有二：一指苦能坚阴（B错），意即泻火存阴，如黄柏、知母即是；二指坚厚肠胃（E错），如投用少量苦味的黄连，有厚肠止泻作用等。苦味药大多能伤津、伐胃，津液大伤及脾胃虚弱者不宜大量用。